某男，46岁。感冒5日，症见发热、咳嗽、咽痛。治当疏风解表、清热解毒，宜选用的成药是
A. 荆防颗粒
B. 感冒清热颗粒
C. 九味羌活颗粒
D. 双黄连颗粒
E. 连花清瘟胶囊

正确答案：D。双黄连颗粒

解析：本题考查的是双黄连合剂的功能。某男，46岁。感冒5日，症见发热、咳嗽、咽痛。治当疏风解表、清热解毒，宜选用的成药是双黄连颗粒（D对）。双黄连合剂：【功能】疏风解表，清热解毒。荆防颗粒（A错）：【功能】解表散寒，祛风胜湿。感冒清热颗粒（B错）：【功能】疏风散寒，解表清热。九味羌活丸（C错）：【功能】疏风解表，散寒除湿。连花清瘟胶囊（E错）：【功能】清瘟解毒，宣肺泄热。